属于黏合剂的是
A. 硬脂酸镁
B. 依地酸二钠
C. 微晶纤维素
D. 羧甲基纤维素钠
E. 碳酸氢钠

正确答案：D。羧甲基纤维素钠

解析：本题考查片剂的附加剂。常用的黏合剂有淀粉浆、甲基纤维素、羟丙基纤维素、羟丙基甲基纤维素、羧甲基纤维素钠（D对）。